不是胸主动脉分支的是
A. 第1、2对肋间后动脉
B. 食管动脉
C. 肋下动脉
D. 支气管动脉
E. 膈上动脉

正确答案：A。第1、2对肋间后动脉

解析：第1、2对肋间后动脉（A错，为本题正确答案）不是胸主动脉分支。食管动脉（B对）、肋下动脉（C对）、支气管动脉（D对）均为胸主动脉的分支。胸主动脉属压力感受器（E对）。